男性，56岁，左颈淋巴结肿大，伴发热，检查弥漫性混合性细胞淋巴瘤，左腹股沟淋巴结2cm×2cm大小，无压痛，脾肋下2cm，骨髓淋巴瘤细胞0.12，诊断属何期
A. ⅠB
B. ⅡA
C. ⅢB
D. ⅣA
E. ⅣB

正确答案：E。ⅣB

解析：患者有发热症状，可以归为B组，而骨髓淋巴瘤细胞0.12为结外病变，定为Ⅳ期，所以此患者的淋巴瘤诊断为ⅣB期。掌握“淋巴瘤”知识点。